临床诊疗工作中的有效原则，要求医务人员应做到
A. 学习和掌握偏方等诊疗手段
B. 认真实施有效治疗
C. 治疗中若出现偏差，自己知道就行了
D. 根据患者自我判断诊断治疗效果
E. 医疗操作常规根据患者情况不同可以进行修改

正确答案：B。认真实施有效治疗